基础治疗后，牙周袋深度超过多少时需做翻瓣刮治术
A. 3mm
B. 4mm
C. 5mm
D. 6mm
E. 7mm

正确答案：C。5mm

解析：基础治疗后6～12周时，应复查疗效，若仍有5mm以上的牙周袋，且探诊仍有出血，或有些部位的牙石难以彻底清除，则可视情况决定再次刮治或需进行牙周手术。掌握“慢性牙周炎的治疗原则、程序及方法”知识点。